不属于腹膜内器官的是
A. 卵巢
B. 回肠
C. 脾
D. 空肠
E. 胰

正确答案：E。胰

解析：不属于腹膜内器官的是胰（E错，为本题正确答案），胰位于腹后壁（腹膜后）。器官与腹膜的关系总结如下：（一）腹膜内位器官：脏器表面几乎全部由腹膜所覆盖的为腹膜内位器官，有胃、十二指肠上部、空肠（D对）、回肠（B对）、盲肠、阑尾、横结肠、乙状结肠、脾（C对）、卵巢（A对）和输卵管等。（二）腹膜间位器官：脏器表面大部分由腹膜覆盖的为腹膜间位器官，有肝、胆囊、升结肠、降结肠、子宫、膀胱和直肠上段。（三）腹膜外位器官：脏器仅一面由腹膜覆盖的为腹膜外位器官，有肾、肾上腺、输尿管、十二指肠降部、下部和升部、直肠中段和下段以及胰。这些器官大多位于腹膜后间隙，临床上又称腹膜后位器官。